目前，造成儿童青少年视力低下的主要原因是
A. 近视
B. 远视
C. 弱视
D. 红眼病
E. 沙眼

正确答案：A。近视